伦理审查的特殊方式有
A. 简易审查
B. 跟踪审查
C. 多中心研究的伦理审查
D. 与境外的合作研究的伦理审查
E. 以上均正确

正确答案：E。以上均正确

解析：伦理审查的特殊方式有简易审查；跟踪审查；多中心研究的伦理审查；与境外的合作研究的伦理审查；心理研究的伦理审查。掌握“医学伦理委员会及医学伦理审查”知识点。